体液调节的特点不包括
A. 反应迅速，起作用快，调节精确
B. 作用缓慢
C. 作用面较广泛
D. 调节方式相对恒定
E. 作用持久

正确答案：A。反应迅速，起作用快，调节精确

解析：与神经调节相比，体液调节是一种较为原始的调节方式，其作用缓慢（B对）而持久（E对），作用面较广泛（C对），调节方式相对恒定（D对），神经调节：反应迅速，起作用快，调节精确（A错，为本题正确答案）是神经调节的特点。